钾代谢障碍与酸碱平衡紊乱常互为影响，下述何者是正确的
A. 低钾血症常引起代谢性酸中毒
B. 高钾血症常引起代谢性碱中毒
C. 代谢性碱中毒常引起高钾血症
D. 代谢性酸中毒常引起低钾血症
E. 混合性酸中毒常引起高钾血症

正确答案：E。混合性酸中毒常引起高钾血症

解析：低钾血症时K＋由细胞内移出，与H＋交换增加，细胞外液中的H＋浓度降低，出现代谢性碱中毒（A错）。低钾血症时K＋移入细胞内，与H＋交换增加，细胞外液中的H＋浓度增加，出现代谢性酸中毒（B错）。碱中毒时细胞外液H＋浓度降低，细胞内H＋向细胞外转移，而外液中K＋向细胞内转移以维持电荷平衡而出现低钾血症（C错）。酸中毒时细胞外液H＋浓度升高，细胞外H＋向细胞内转移，而细胞中K＋向细胞外转移以维持电荷平衡而出现高钾血症（E对D错）。